阿托品用于虹膜睫状体炎溶液为
A. 0%～0.5%
B. 0.5%～1%
C. 1%～1.5%
D. 1.5%～2%
E. 2%～2.5%

正确答案：B。0.5%～1%

解析：虹膜睫状体炎：0.5%～1%阿托品溶液滴眼，可松弛虹膜括约肌和睫状肌，使之充分休息，有助于炎症消退。尚可与缩瞳药交替应用，预防虹膜与晶状体的粘连。掌握“阿托品”知识点。